用于定量的参数是
A. 色谱峰高或峰面积
B. 死时间
C. 色谱峰保留时间
D. 色谱峰宽
E. 色谱基线

正确答案：A。色谱峰高或峰面积

解析：本题考查色谱法。在色谱法中，用于定量的参数是色谱峰高或峰面积（A对）。峰高定义为组分色谱峰顶点与基线之间的垂直距离；峰面积定义为色谱峰曲线与基线间包围的面积，两者可用于定量参数。死时间（B错）定义为不保留组分（不溶于固定相或不被固定相所吸附）的保留时间。保留时间（C错）定义为由进样到某组分色谱峰峰顶的时间间隔，相同物质在相同的条件下，保留时间一致，故保留时间可作为定性参数。色谱峰宽（D错）定义为通过色谱峰两侧的拐点作切线，在基线上的截距，用于衡量柱效。基线（E错）定义为仅有流动相通过检测器时，所得到的流出曲线。基线可以反映仪器及操作条件的恒定程度。